喉返神经
A. 支配所有喉肌
B. 与甲状腺下动脉交叉
C. 与喉上神经喉内支性质相同
D. 勾绕锁骨下动脉
E. 无

正确答案：B。与甲状腺下动脉交叉

解析：左、右喉返神经分别行于两侧气管与食管之间的沟内或附近，有甲状腺下动脉与其伴行（B对）。喉返神经分布于声门裂以下喉黏膜及除环甲肌外的所有喉肌（A错）。右喉返神经在右迷走神经经过右锁骨下动脉前方处发出，由前向后绕过右锁骨下动脉返回向上（D错）。